患者，男性，30岁。淋雨后，体温波动于39～40℃。X线片示右肺下叶炎性实变阴影，右胸膜腔积液。最常见的致病菌是
A. 厌氧菌
B. 军团菌
C. 葡萄球菌
D. 肺炎球菌
E. 大肠埃希菌

正确答案：D。肺炎球菌

解析：本题考查肺炎链球菌肺炎的致病菌。患者，男性，30岁。淋雨后（淋雨为常见诱因），体温波动于39～40℃。X线片示右肺下叶炎性实变阴影，右胸膜腔积液，应考虑为肺炎链球菌肺炎。最常见的致病菌是肺炎球菌（D对）。厌氧菌（A错）引起的肺炎常有吸入病史，高热、腥臭痰、毒血症症状明显，X线可见支气管肺炎、脓胸、脓气胸，多发性肺脓肿。军团菌（B错）引起的肺炎高热、肌痛、相对缓脉，X线可见下叶斑片浸润，进展迅速，无空洞。葡萄球菌（C错）引起的肺炎起病急、寒战、高热、脓血痰、气急、毒血症症状、休克，X线可见肺叶或小叶浸润，早期空洞，脓胸，可见液气囊腔。大肠埃希菌（E错）引起肺炎常原有慢性病，发热、脓痰、呼吸困难，X线可见支气管肺炎，脓胸的征象。